6个月婴儿，呕吐，腹泻3天，大便10余次/日，呈蛋花汤样，有腥臭味，尿量极少，皮肤弹性差，前囟、眼窝明显凹陷，四肢厥冷。大便镜检白细胞偶见。血清钠135mmol/L。进行补液治疗，首批静脉输液应给予
A. 2：1等张含钠液20ml/kg
B. 2：1等张含钠液100～120ml/kg
C. 1/2张含钠液100～200ml/kg
D. 2/3张含钠液50～100ml/kg
E. 1/2张含钠液50～100ml/kg

正确答案：A。2：1等张含钠液20ml/kg

解析：根据该患儿皮肤弹性差，前囟眼窝明显凹陷，四肢厥冷，尿量极少，血清钠135mmol/L，符合等渗性重度脱水的标准，因此第一批补液需要扩容，应用生理盐水或2：1等张含钠液20ml/kg（A对），按20ml/kg于30分钟至1小时输入，其余按照累计损失量，补充1/2张含钠液。